关于片剂特点的说法，错误的是
A. 用药剂量相对准确、服用方便
B. 易吸潮，稳定性差
C. 幼儿及昏迷患者不易吞服
D. 种类多，运输携带方便，可满足不同临床需要
E. 易于机械化、自动化生产

正确答案：B。易吸潮，稳定性差

解析：本题考查片剂的特点。片剂的优点之一是受外界空气、水分、光线等影响较小、化学性质更稳定，所以不易吸潮，稳定性好（B错，为本题正确答案）。片剂还有其它优点：用药剂量相对准确、服用方便（A对）、种类多，运输携带方便，可满足不同临床需要（D对）、易于机械化、自动化生产（E对）。片剂的缺点之一是幼儿及昏迷患者不易吞服（C对）。